口腔颌面部常见的癌前状态不包括
A. 口腔黏膜下纤维性变
B. 先天性角化不良
C. 口腔粘膜白斑
D. 着色性干皮病
E. 上皮过度角化

正确答案：C。口腔粘膜白斑

解析：癌前状态：口腔面颊部常见的癌前状态被认为有口腔扁平苔藓、口腔黏膜下纤维性变、盘状红斑狼疮、上皮过度角化、先天性角化不良以及梅毒、着色性干皮病等。掌握“口腔颌面部肿瘤的治疗原则及预防”知识点。